女孩，1岁。腹泻4天。每日大便10余次，为蛋花汤水样便，伴呕吐、尿少。查体：T38.5℃，前囟、眼窝凹陷，皮肤弹性差，四肢稍凉。实验室检查：血WBC3.6×10⁹/L，血Na⁺127mmol/L，血K⁺3.7mmol/L，BE-15mmol/L。最可能的病原体是
A. 侵袭性大肠埃希菌
B. 白色念珠菌
C. 产毒性大肠埃希菌
D. 金黄色葡萄球菌
E. 轮状病毒

正确答案：E。轮状病毒

解析：女性患儿，腹泻4天。每日大便10余次，为蛋花汤水样便，伴呕吐、尿少。查体：T38.5℃，前囟、眼窝凹陷，皮肤弹性差，四肢稍凉。实验室检查：血WBC3.6×10⁹/L（正常值4.0～10.0×10⁹/L），血Na⁺127mmol/L（正常值130～150mmol/L），血K⁺3.7mmol/L（正常值3.5～5.5mmol/L），BE-15mmol/L（正常值－3～＋3mmol/L）。综合患者的症状、体征和辅助检查，最可能的病原体是轮状病毒（E对）。侵袭性大肠埃希菌（A错）多急性起病，大便呈黏液状，带脓血，有腥臭味。白色念珠菌（B错）病程迁延，常伴鹅口疮。黄色稀便，泡沫较多，带黏液，有时可见豆腐渣样细块（菌落）。产毒性大肠埃希菌（C错）为水样便，很少发热。金黄色葡萄球菌（D错）典型大便大便为暗绿色，多带黏液，少数为血便。